用于治疗湿性视网膜黄斑变性的药物是
A. 聚乙二醇滴眼液
B. 硫酸阿托品眼用凝胶
C. 雷珠单抗注射液
D. 毛果芸香碱滴眼液
E. 丙美卡因滴眼液

正确答案：C。雷珠单抗注射液

解析：本题考查雷珠单抗注射液。用于治疗湿性视网膜黄斑变性的药物是雷珠单抗注射液（C对）。雷珠单抗注射液为血管内皮生长因子（VEGF）抑制剂，通过竞争性地抑制VEGF与受体的结合，从而抑制内皮细胞增殖和血管新生。用于治疗湿性（新生血管性）年龄相关性黄斑病变。聚乙二醇滴眼液（A错）为干眼症用药，属高分子聚合物，具有亲水性和成膜性，在适宜浓度下，能起人工泪液的作用。用于暂时缓解由于眼睛干涩引起的灼热和刺痛症状。硫酸阿托品眼用凝胶（B错）为散瞳药，用于虹膜睫状体炎、检查眼底前的散瞳、验光配镜屈光度检查前的散瞳。毛果芸香碱滴眼液（D错）选择性直接作用于M胆碱受体。主要用于①治疗原发性青光眼，包括开角型与闭角型青光眼。②用于激光虹膜造孔术前使虹膜伸展便于激光打孔，以及防止激光手术后的反应性眼压升高。③本品滴眼用于眼科手术后或应用扩瞳剂后，以抵消睫状肌麻痹剂或散瞳药的作用。④注射液可用于白内障人工晶状体植入手术中缩瞳。丙美卡因滴眼液（E错）用于眼科局部麻醉。